骨关节炎最典型的X线表现是
A. 关节肿胀
B. 关节周围骨质疏松
C. 关节软骨侵蚀
D. 软骨下骨软化
E. 关节间隙变窄

正确答案：E。关节间隙变窄

解析：骨关节炎的典型 X 线表现为受累关节软骨下骨质硬化 、囊 变，关节边缘骨赘形成，受累关节间隙狭窄。